位于小腿内侧，内踝尖上3寸，胫骨内侧缘后际的腧穴是
A. 血海
B. 阴陵泉
C. 三阴交
D. 悬钟
E. 地机

正确答案：C。三阴交

解析：三阴交定位在小腿内侧，内踝尖上3寸，胫骨内侧缘后际（C对）。血海定位在股前区，髌底内侧端上2寸，股内侧肌隆起处（A错）。阴陵泉定位在小腿内侧，胫骨内侧髁缘与胫骨内侧缘之间的凹陷中（B错）。悬钟定位在小腿外侧，外踝尖上3寸，腓骨前缘（D错）。地机定位于小腿内侧，阴陵泉下3寸，胫骨内侧缘后际（E错）。